S-曲线的特点是
A. 曲线开始平缓，中间陡峭，最后又趋平缓
B. 曲线开始平缓，中间平缓，最后陡峭
C. 曲线开始陡峭，中间平缓，最后仍平缓
D. 曲线开始陡峭，中间陡峭，最后平缓

正确答案：A。曲线开始平缓，中间陡峭，最后又趋平缓

解析：本题考查S-曲线的特点。S-曲线的特点是曲线开始平缓，中间陡峭，最后又趋平缓（A对BCD错）。